男，35岁。因服吲哚美辛数片后觉胃痛，今晨呕咖啡样胃内容物400ml来诊。既往无胃病史。首选的检查是
A. 血清胃泌素测定
B. B型超声检查
C. X线胃肠钡餐
D. 急诊胃镜检查
E. 胃液分析

正确答案：D。急诊胃镜检查

解析：中年男性患者，服用吲哚美辛（服用非甾体抗炎药为急性胃炎的常见病因）后觉胃痛，伴呕咖啡样胃内容物400ml（呕血），疑诊为急性胃炎，确诊依靠急诊胃镜检查（D对），可发现糜烂及出血灶。血清胃泌素测定（A错）主要用于胃泌素瘤诊断和疗效监测。B型超声检查（B错）常用于腹腔实质脏器病变的辅助诊断。X线胃肠钡餐（C错）是消化性溃疡和胃癌的间接诊断方法，且急性期出血不推荐使用。胃液分析（E错）用于测定胃酸基础分泌量和最大分泌量，可用于消化性溃疡、慢性胃炎的辅助检查。